胃短动脉来自
A. 腹腔干
B. 肝总动脉
C. 胃十二指肠动脉
D. 肝固有动脉
E. 脾动脉

正确答案：E。脾动脉

解析：脾动脉（E对）入脾门前发出数条分支，包括胃短动脉、胃后动脉、胃网膜左动脉、胰支、脾支。